Ⅰ型单纯疱疹病毒复发感染的常见部位是
A. 颊黏膜
B. 舌背黏膜
C. 舌腹及舌侧缘黏膜
D. 唇黏膜
E. 唇红及周缘皮肤

正确答案：E。唇红及周缘皮肤

解析：本题考查Ⅰ型单纯疱疹病毒的感染部位。Ⅰ型单纯疱疹病毒复发感染的常见部位是唇红及周缘皮肤（E对）。单纯疱疹病毒分为Ⅰ型单纯疱疹病毒和Ⅱ型单纯疱疹病毒。Ⅰ型单纯疱疹病毒主要引起口腔黏膜、咽、口周皮肤、面部、腰以上皮肤黏膜及脑的感染；Ⅱ型疱疹病毒主要引起腰部以下的皮肤黏膜及生殖器的感染。